葛根芩连丸除解肌清热外，又能
A. 益气固表
B. 发汗解表
C. 解表清热
D. 宣肺止咳
E. 止泻止痢

正确答案：E。止泻止痢

解析：本题考查的是葛根芩连丸的功能。葛根芩连丸除解肌清热外，又能（E对）。葛根芩连丸：【功能】解肌透表，清热解毒，利湿止泻。葛根芩连丸，功能解肌透表、清热解毒、利湿止泻，主冶泄泻、痢疾属于里热为主，而表证未解者。固本咳喘片：【功能】益气固表（A错），健脾补肾。表实感冒颗粒：【功能】发汗解表（B错），祛风散寒。感冒清热颗粒：【功能】疏风散寒，解表清热（C错）。桑菊感冒片：【功能】疏风清热，宣肺止咳（D错）。